男，2岁。面色苍白半年，易疲乏，精神不集中。时而烦躁、纳差，异食癖。查体：皮肤及唇口腔黏膜苍白，肝脾肋下2指。实验室检查：Hb86g/L，RBC3.0×10¹²/L，MCV65，MCHC0.25最可能诊断是
A. 叶酸缺乏性贫血
B. 维生素B₁₂缺乏性贫血
C. 营养性缺铁性贫血
D. 再生障碍性贫血
E. 生理性贫血

正确答案：C。营养性缺铁性贫血

解析：患儿面色苍白，皮肤、唇、口腔黏膜苍白，呈贫血貌；肝脾肿大提示有代偿性髓外造血；实验室检查提示血红蛋白低，MCV、MCHC均低于正常值，提示为小细胞低色素贫血，多见营养性缺铁性贫血（C对）。叶酸、维生素B12缺乏所致的贫血为巨幼细胞贫血（P358）（AB错），MCV、MCHC大于正常值。再生障碍性贫血（D错）为骨髓造血功能障碍引起的全血细胞减少，MCV、MCHC均在正常范围内。生理性贫血（E错）多发生于出生后2～3月时，由于婴儿生长迅速，循环血量增加，骨髓造血功能暂时性下降引起的一种特殊生理现象。